山茱萸除能收敛外，还能
A. 止痛
B. 涩肠
C. 固脱
D. 止带
E. 燥湿

正确答案：C。固脱

解析：本题考查的是山茱萸的功效。山茱萸除能收敛外，还能固脱（C对）。山茱萸：【功效】补益肝肾，收敛固脱。海螵蛸：【功效】收敛止血，固精止带，制酸止痛（A错），收湿敛疮。椿皮：【功效】清热燥湿（E错），涩肠（B错），止血，止带（D错），杀虫。